对乙肝病毒感染具有保护作用的是
A. 抗HBe
B. 抗HBs
C. DNA聚合酶
D. 抗核抗体
E. 抗HBc

正确答案：B。抗HBs

解析：抗HBs对乙肝病毒感染具有保护作用。掌握“病毒性肝炎”知识点。